脊髓第2胸节右侧后索损伤后出现
A. 左半身乳头平面以下深部感觉和精细触觉丧失
B. 右半身乳头平面以下痛、温度觉和粗略触觉丧失
C. 左半身胸骨角平面以下痛、温度觉和粗略触觉丧失
D. 右半身胸骨角平面以下深部感觉和精细触觉丧失
E. 以上均不正确

正确答案：D。右半身胸骨角平面以下深部感觉和精细触觉丧失

解析：脊髓第2胸节右侧后索内含薄束和楔束，传导导同侧躯干及上下肢的肌、腿、关节的本体感觉（位置觉、运动觉和震动觉）和皮肤的精细触觉（如通过触摸辨别物体纹理粗细和两点距离）信息，损伤后导致右半身胸骨角平面以下深部感觉和精细触觉丧失（D对）。